链球菌的形态和排列用什么染色
A. 瑞氏染色
B. 抗酸染色
C. 墨汁负染色
D. 棉兰染色
E. 革兰染色

正确答案：E。革兰染色

解析：本题考查链球菌属。链球菌的形态和排列用革兰染色（E对）。链球菌属革兰氏染色为阳性，呈链状排列，无鞭毛，不形成芽孢，幼龄菌可有透明质酸形成的荚膜。瑞氏染色（A错）适用于组织胞浆菌。抗酸染色（B错）用于结核分枝杆菌。墨汁负染色（C错）用于新型隐球菌荚膜。棉兰染色（D错）主要用于真菌。